下列关于婴幼儿阶段脑发育的年龄特征，有哪一点是不正确的
A. 出生时大脑结构接近成人，脑重量达到成人脑重1/4左右
B. 婴儿期脑重量增长快，神经细胞数量增加，大脑加速髓鞘化
C. 幼儿期脑功能的单侧化程度是脑细胞成熟的重要指标
D. 幼儿期脑神经突触联系加强，条件反射大量形成、巩固和稳定
E. 生命早期大脑有良好修复性。一旦某侧脑半球受损，另一侧可出现代偿功能

正确答案：B。婴儿期脑重量增长快，神经细胞数量增加，大脑加速髓鞘化